关于注射用溶剂的正确表述有
A. 纯化水是原水经蒸馏等方法制得的供药用的水，不含任何附加剂
B. 注射用水是纯化水再经蒸馏所制得的水，亦称无热原水
C. 灭菌注射用水是注射用水经灭菌所制得的水，是无菌、无热原的水
D. 制药用水是一个大概念，它包括纯化水、注射用水和灭菌注射用水
E. 注射用水主要用于注射用无菌粉末的溶剂或注射液的稀释剂

正确答案：A、B、C、D。纯化水是原水经蒸馏等方法制得的供药用的水，不含任何附加剂；注射用水是纯化水再经蒸馏所制得的水，亦称无热原水；灭菌注射用水是注射用水经灭菌所制得的水，是无菌、无热原的水；制药用水是一个大概念，它包括纯化水、注射用水和灭菌注射用水

解析：本题考查注射用溶剂。水被广泛用于药物的生产中，制药用水可分为饮用水、纯化水、注射用水和灭菌注射用水（D对），应根据生产工序或使用目的与要求选用适宜的制药用水。纯化水为饮用水经蒸馏法、离子交换法、反渗透法或其他适宜的方法制备的制药用水，不含任何附加剂（A对）。灭菌注射用水为注射用水按照注射剂生产工艺制备所得，不含任何添加剂（C对）。注射用水为纯化水经蒸馏所得的水，应符合细菌内毒素试验要求（B对）。注射用水可作为配制注射剂、滴眼剂等的溶剂或稀释剂及容器的精洗。灭菌注射用水可作为注射用灭菌粉末的溶剂或注射剂的稀释剂（E错）。